对药品不良反应，国家实行的是
A. 不定期报告制度
B. 定期报告制度
C. 随时报告制度
D. 逐级报告制度
E. 越级报告制度

正确答案：B、D。定期报告制度；逐级报告制度

解析：本题考查药品不良反应。《中华人民共和国药品管理法》规定国家实行药品不良反应报告制度。药品不良反应应定期报告（B对），逐级报告（D对），必要时可以越级报告（E错）。